大气质量玫瑰图，其中圆内数据表示
A. I₁大气质量指数
B. I₂大气污染超标指数
C. PSI指数
D. AQI指数
E. 幂函数环境质量指数

正确答案：B。I₂大气污染超标指数

解析：本题考查大气质量玫瑰图中圆内数据表示含义。大气质量玫瑰图中圆内数据表示大气污染超标指数I₂（B对ACDE错）：a，b，c，d，e长度依次代表SO₂（1小时浓度）、SO₂（日平均浓度）、N0₂（1小时浓度）、铅（日平均浓度）、总悬浮颗粒（日平均浓度）的超标分指数；p，q，r，s长度依次代表SO₂，N0₂，铅和总悬浮颗粒的I₁分指数比例尺。